下列哪项不是卫生费用的评价指标
A. 卫生费用占GNP百分比
B. 人均卫生费用
C. 门诊和住院费用构成
D. 医疗部门的人力费用

正确答案：D。医疗部门的人力费用

解析：本题考查卫生费用的评价指标。卫生费用的评价指标有：1.卫生总费用占国内生产总值百分比（A对）；2.人均卫生费用（B对）；3.政府财政预算卫生支出占卫生总费用百分比；4.卫生事业费占财政支出百分比；5.卫生各部门的投资比例；6.门诊和住院费用构成（C对）；7.医疗、预防保健的比例。医疗部门的人力费用（D错，为本题正确答案）不是卫生费用的评价指标。